太息表示
A. 心气不足
B. 肝气郁结
C. 脾气下陷
D. 胃气上逆
E. 肺气上逆

正确答案：B。肝气郁结

解析：太息又称叹息，指患者情志抑郁，胸闷不畅时发出的长吁或短叹声。常是情志不遂，肝气郁结的表现（B对）。心气不足（A错）可见独语、错语。脾气下陷（C错）可见泄泻。胃气上逆（D错）可见呃逆。肺气上逆（E错）可见咳嗽。